新生隐球菌引起的主要疾病是
A. 慢性脑膜炎
B. 流行性脑脊髓膜炎
C. 流行性乙型脑炎
D. 鹅口疮
E. 原发性非典型肺炎

正确答案：A。慢性脑膜炎

解析：新生隐球菌最易侵犯中枢神经系统，引起慢性脑膜炎，预后不良，常可导致患者死亡。掌握“真菌概述及主要病原性真菌”知识点。